天地万物相互联系的中介是
A. 阴阳
B. 地气
C. 阳气
D. 天气
E. 精气

正确答案：E。精气

解析：气学说认为，气是世界万物的本原，是构成万物的基本要素，气的运动变化是万物运动变化的原动力，气是万物相互联系的中介（E对）。